伴有低血钾的高血压，其病因应首先考虑
A. 皮质醇增多症
B. 原发性醛固酮增多症
C. 嗜铬细胞瘤
D. 慢性肾炎
E. 肾动脉狭窄

正确答案：B。原发性醛固酮增多症

解析：醛固酮的生理作用是保水保钠排钾。原发性醛固酮增多症由于肾上腺皮质增生，醛固酮分泌增多，保水保钠增强，引起水钠潴留，导致高血压；排钾作用增强，导致低钾血症，临床上常以长期高血压伴低血钾为特征。因此伴有低血钾的高血压，其病因应首先考虑原发性醛固酮增多症（B对）。皮质醇增多症（P260）（A错）主要为糖皮质激素过多，而糖皮质激素具有弱醛固酮的作用，也可引起高血压伴低血钾，但其并非特征性症状。嗜铬细胞瘤（P711）（C错）仅少数患者可出现低钾血症。慢性肾炎（D错）由于肾功能受损，导致排钾能力下降，可出现高钾血症。肾动脉狭窄（E错）所导致的高血压一般无低血钾的表现。